《药品经营质量管理规范》规定不合格药品库（区）是
A. 蓝色标志
B. 红色标志
C. 黄色标志
D. 绿色标志
E. 橙色标志

正确答案：B。红色标志

解析：本题考查药品储存。《药品经营质量管理规范》规定不合格药品库（区）是红色标志（B对）。根据《药品经营质量管理规范》，在人工作业的库房储存药品，按质量状态实行色标管理：合格药品为绿色（D错），不合格药品为红色，待确定药品为黄色（C错）。